劳动系统对人总的需求和压力在劳动生理称为
A. 应力
B. 应变
C. 反应
D. 应激
E. 负荷

正确答案：E。负荷